牙颌面畸形的治疗包括
A. 术前正畸治疗
B. 确认手术计划
C. 正确施术
D. 完成术前准备
E. 以上都是

正确答案：E。以上都是

解析：牙颌面畸形的正颌外科治疗，在确定治疗方案后，必须按照严格的治疗程序进行，才能获得最佳的预期效果及避免可能出现的误差。根据实践经验，其治疗程序可归纳如下：①术前正畸治疗；②确认手术计划；③完成术前准备；④正确施术；⑤术后正畸治疗；⑥追踪观察。掌握“牙颌面畸形”知识点。